采取专业性洁治，去除菌斑和牙石属于
A. 基本急诊保健
B. 牙周病一级预防
C. 牙周病二级预防
D. 牙周病三级预防
E. 社区牙周保健

正确答案：C。牙周病二级预防

解析：二级预防旨在早期发现、早期诊断、早期治疗，减轻已发生的牙时病的严重程度，控制其发展。对局限于牙龈的病变，及时采取专业性洁治，去除菌斑和牙石。控制其进一步发展。采用X线检查法定期追踪观察牙槽骨情况，根据具体情况采取适当的治疗，改善牙周组织的健康状况。二级预防的效果是在一级预防基础上取得的，其远期效果与患者是否能长期坚持各种预防措施有关。掌握“牙周病流行病学及分级预防”知识点。